半夏的功效是
A. 燥湿化痰
B. 降逆止呕
C. 祛风止痉
D. 消痞散结
E. 通络止痛

正确答案：A、B、D。燥湿化痰；降逆止呕；消痞散结

解析：本题考查的是半夏的功效。半夏的功效是燥湿化痰（A对）、降逆止呕（B对）与消痞散结（D对）。半夏：【功效】燥湿化痰，降逆止呕，消痞散结。天南星：【功效】燥湿化痰，祛风止痉（C错），散结消肿。芥子：【功效】温肺祛痰，利气散结，通络止痛（E错）。